以下内容中哪项符合Gorlin综合征中的表现
A. 成釉细胞瘤
B. 牙瘤
C. 牙源性角化囊性瘤
D. 化脓性腮腺炎
E. 含牙囊肿

正确答案：C。牙源性角化囊性瘤

解析：痣样基底细胞癌综合征又称为颌骨囊肿基底细胞痣-肋骨分叉综合症或Gorlin综合征，可累及多种组织或器官，其症候群主要包括：①多发性皮肤基底细胞癌；②颌骨多发性牙源性角化囊性瘤；③骨骼异常；④额部和颞顶部隆起，眶距过宽和轻度下颌前凸，构成特征性面部表现；⑤钙、磷代谢异常。综合征患者较年轻，常有家族史，具有常染色体显性遗传特点。本综合征的发生与PTCH基因突变有关。掌握“牙源性角化囊性瘤”知识点。